适用于阿司匹林哮喘伴过敏性鼻炎的预防和维护治疗的药物是
A. 异丙托溴铵气雾剂
B. 孟鲁司特钠咀嚼片
C. 茶碱片
D. 沙丁胺醇气雾剂
E. 布地奈德吸入剂

正确答案：B。孟鲁司特钠咀嚼片

解析：本题考查支气管哮喘用药。适用于阿司匹林哮喘伴过敏性鼻炎的预防和维护治疗的药物是孟鲁司特（B对）。孟鲁司特为白三烯受体阻断剂（LTRA），LTRA 服用方便，尤其适用于伴有过敏性鼻
炎、阿司匹林哮喘、运动性哮喘患者的治疗。异丙托溴铵气雾剂（A错）为吸入性抗胆碱药。茶碱片（C错）为茶碱类药物。沙丁胺醇气雾剂（D错）为短效β₂受体激动剂。布地奈德吸入剂（E错）为糖皮质激素类药物。